学生蛔虫感染率低于40%的地区，采用集体驱蛔的正确方法是
A. 对该地区所有学生进行集体驱蛔
B. 对该地区所有人群进行集体驱蛔
C. 对该地区学生粪检阳性者进行集体驱蛔
D. 对该地区所有粪检阳性者进行集体驱蛔
E. 蛔虫感染是自愈性疾病，不必采取任何措施

正确答案：C。对该地区学生粪检阳性者进行集体驱蛔